在慢性排斥反应中，有关Th1介导的慢性Ⅳ型超敏反应使植物发生
A. 动脉硬化
B. 进行性纤维化
C. 血管平滑肌细胞增生
D. 血管壁炎症细胞浸润
E. 以上说法均正确

正确答案：E。以上说法均正确

解析：在慢性排斥反应中，Th1介导的慢性Ⅳ型超敏反应使植物发生血管平滑肌细胞增生、动脉硬化、血管壁炎症细胞浸润和进行性纤维化。掌握“移植免疫”知识点。